下列哪一项不是社会医学的研究内容
A. 研究社会卫生状况，主要是人群健康状况
B. 研究影响人群健康的因素，特别是社会因素
C. 研究解决人群健康状况的具体医疗技术措施
D. 提出改善社会卫生状况的社会性策略与措施

正确答案：C。研究解决人群健康状况的具体医疗技术措施

解析：本题考查社会医学的研究内容。社会医学的研究内容主要包括：1.研究社会卫生状况，主要是人群健康状况（A对）；2.研究影响人群健康的因素，特别是社会因素（B对）；3.研究社会卫生策略和措施（D对）。研究解决人群健康状况的具体医疗技术措施（C错，为本题正确答案）不是社会医学的研究内容。